在痛风急性发作期，为抑制粒细胞浸润，应选用的抗痛风药品是
A. 秋水仙碱
B. 别嘌醇
C. 苯溴马隆
D. 非布索坦
E. 阿司匹林

正确答案：A。秋水仙碱

解析：本题考查秋水仙碱。秋水仙碱（A对）与中性白细胞微管蛋白的亚单位结合而改变细胞膜功能，抑制粒细胞浸润和白细胞趋化，可用于痛风的急性期；别嘌醇（B错）是抑制黄嘌呤氧化酶，阻止黄嘌呤和次黄嘌呤代谢为尿酸；苯溴马隆（C错）是抑制近端肾小管对尿酸盐的重吸收，使尿酸排出增加；非布索坦（D错）为XOR抑制剂，作用于XOR氧化酶，减少体内尿酸合成；阿司匹林（E错）为COX抑制剂。